薏苡仁的功效是
A. 利水渗湿，凉血止血
B. 利水通淋，渗湿止泻
C. 利水通淋，通经下乳
D. 利水渗湿，除痹排脓
E. 利水清热，通气下乳

正确答案：D。利水渗湿，除痹排脓

解析：本题考查薏苡仁的功效。薏苡仁的功效是利水渗湿，除痹排脓（D对）。薏苡仁【功效】利水渗湿，健脾止泻，除痹，清热排脓。石韦【功效】利尿通淋，凉血止血（A错），清肺止咳。车前子【功效】利水通淋，渗湿止泻（B错），明目，清肺化痰。木通【功效】利水通淋，泄热，通经下乳（C错）。通草【功效】利水清热，通气下乳（E错）。